不合理处方可以分为不规范处方、用药不适宜处方和超长处方，下列处方属于存在用药不适宜情况的是
A. 处方医生签名不能准确识别的处方
B. 慢性病需延长处方用量未注明理由的处方
C. 中成药与中药饮片为分别开具的处方
D. 存在有潜在临床意义的配伍禁忌的处方

正确答案：D。存在有潜在临床意义的配伍禁忌的处方

解析：本题考查的是处方审核内容。不合理处方可以分为不规范处方、用药不适宜处方和超长处方，下列处方属于存在用药不适宜情况的是存在有潜在临床意义的配伍禁忌的处方（D对）。适宜性审核包括：（1）规定必须做皮试的药品,处方医师是否注明过敏试验及结果的判定；（2）处方用药与临床诊断的相符性；（3）剂量、用法的正确性；（4）选用剂型与给药途径的合理性；（5）是否有重复给药现象；（6）是否有潜在临床意义的药物相互作用和配伍禁忌；（7）其它用药不适宜情况。处方医师签名不能准确识别的处方（A错）属于不能判定合法性处方。慢性病需延长处方用量未注明理由的处方（B错）、中成药与中药饮片未分别开具的处方（C错）属于不规范处方。